体内活性代谢物为坎利酮的利尿药是
A. 呋塞米
B. 氢氯噻嗪
C. 依他尼酸
D. 螺内酯
E. 阿米洛利

正确答案：D。螺内酯

解析：本题考查螺内酯的代谢。体内活性代谢物为坎利酮的利尿药是螺内酯（D对）。螺内酯口服口起效慢，发挥最大疗效需要2～3日。该药半衰期短，但其代谢产物（坎利酮）具有活性，有较长的作用维持时间（约60h）。呋塞米（A错）、氢氯噻嗪（B错）、依他尼酸（C错）、阿米洛利（E错）的代谢产物均无活性。